男，47岁，既往有慢性乙型病毒性肝炎病史10余年，1月前出现右上腹隐痛不适。査体右腹部膨隆，可扪及质地坚硬、表面凹凸不平的肿块，移动性浊音阳性。腹水为血性，最可能的诊断是
A. 肝包虫病
B. 原发性肝癌
C. 肝囊肿
D. 肝脓肿
E. 肝血管瘤

正确答案：B。原发性肝癌

解析：患者有慢性肝炎病史10年，近来出现右上腹隐痛，右腹部膨隆，查体可扪及质地坚硬表面凹凸不平的肿块，移动性浊音阳性，腹腔穿刺发现血性腹水，应诊断为原发性肝癌（B对），并且癌肿已经发生破裂。肝包虫病（A错）系棘球绦虫的蚴感染所致，初期症状不明显，后期可出现压迫邻近器官而引起如上腹不适、食欲减退、恶心、呕吐黄疸、腹水等症状，还可因过敏反应出现皮肤瘙痒，荨麻疹等症状，而不会出现血性腹水的表现，与该患者表现不相符，故应排除。肝囊肿（C错）早期无症状，后期增大后可出现囊肿压迫症状如餐后饱胀、食欲减退、恶心和呕吐、腹痛、腹部包块、黄疸等症状，而不会出现血性腹水的表现，与该患者表现不相符，故应排除。肝脓肿（D错）主要表现为不规则的脓毒性发热、肝区持续性疼痛，当脓肿穿破至胸腔即出现脓胸，肺脓肿或穿破至腹腔发生腹膜炎，而不会出现血性腹水的表现，与该患者表现不相符，故应排除。肝血管瘤（E错）较小时无症状，增大后可因对胃、十二指肠邻近器官的压迫而产生症状，如上腹部不适、饱胀、嗳气、腹痛等症状，而不会出现血性腹水的表现，与该患者表现不相符，故应排除。